过清音见于
A. 叩击富有弹性、含气量正常的肺组织所产生的音响
B. 叩击含有大量气体的空腔脏器时出现
C. 叩击含气量增多、弹性减退的肺组织时出现
D. 叩击不含气的实质性脏器时出现
E. 叩击各种原因所致含气减少的肺组织时出现

正确答案：C。叩击含气量增多、弹性减退的肺组织时出现

解析：过清音介于鼓音与清音之间，是属于鼓音范畴的一种实音，在叩击含气量增多、弹性减退的肺组织时出现（C对）。叩击富有弹性、含气量正常的肺组织所产生的音响（A错）为清音。叩击含有大量气体的空腔脏器时出现（B错）的是鼓音。叩击不含气的实质性脏器时出现（D错）的是实音。叩击各种原因所致含气减少的肺组织时出现（E错）的是浊音。